地图舌任何年龄均可发生，但多见于
A. 儿童
B. 青年
C. 中年
D. 老年
E. 成人

正确答案：A。儿童

解析：地图舌任何年龄均可发生，但多见于儿童，成年人较少，男女均可发病，无季节性，一般无自觉症状，合并感染时，可出现局部刺激痛。掌握“地图舌、沟纹舌及舌乳头炎”知识点。